五灵脂除活血止痛外，又能
A. 化瘀止血
B. 接骨疗伤
C. 凉血解毒
D. 利尿通淋
E. 消肿排脓

正确答案：A。化瘀止血

解析：本题考查五灵脂的功效。五灵脂除活血止痛外，又能化瘀止血（A对）。五灵脂【功效】活血止痛，化瘀止血，解蛇虫毒。自然铜【功效】散瘀止痛，接骨疗伤（B错）。西红花【功效】活血祛瘀，凉血解毒（C错），解郁安神。滑石【功效】利尿通淋（D错），清解暑热；外用清热收湿敛疮。白芷【功效】发散风寒，通窍止痛，燥湿止带，消肿排脓（E错）。